男，60岁。胸闷气促2周，查体：吸气时BP85/60mmHg，呼气时BP100/75mmHg，心尖搏动减弱，心界向两侧扩大，心率125次/分，律齐。心音低钝遥远，心脏各瓣膜区未闻及杂音。最有助于确诊的辅助检查是
A. 胸部X线片
B. 动态血压监测
C. 心电图
D. 超声心动图
E. 肺功能

正确答案：D。超声心动图

解析：患者老年男性，有胸闷气促症状，查体：吸气时BP85/60mmHg而呼气时BP100/75mmHg（奇脉的典型表现）；心尖搏动减弱、心界向两侧扩大且心音低钝遥远（大量心包积液的典型体征），结合患者的病史和典型体征，该患者考虑为心包积液引起心脏压塞。最有助于确诊心包积液的辅助检查是超声心动图（D对），心脏压塞时超声心动图的特征为：舒张末期右心房塌陷及舒张早期右心室游离壁塌陷。胸部X线片（A错）、心电图（C错）对心包积液的辅助诊断有一定意义，但并非最有助于确诊心脏压塞的辅助检查。动态血压监测（P251）（B错）可用于诊断白大衣高血压，发现隐蔽性高血压，检查顽固难治性高血压的原因，评估血压升高程度、短时变异和昼夜节律以及治疗效果等，一般不用于心包积液的辅诊。肺功能（E错）主要用于某些肺部疾病（如COPD、支气管哮喘等）的辅助诊断。